患者男性，62岁，右上牙龈菜花样肿物发现2个月，约2.0cm×1.3cm×0.7cm大小，活检报告“高分化鳞癌”。X线片示局部牙槽突骨质未见破坏，颌面颈部未触及肿大淋巴结。该患者最佳治疗方案为
A. 病变区上颌骨区域性切除+根治性颈淋巴清扫
B. 病变区上颌骨区域性切除+功能性颈淋巴清扫
C. 病变区上颌骨次全切除，定期复查，密切注意颈部淋巴结情况
D. 病变侧上颌骨次全切除+功能性颈淋巴清扫
E. 病变侧上颌骨次全切除+根治性颈淋巴清扫

正确答案：C。病变区上颌骨次全切除，定期复查，密切注意颈部淋巴结情况

解析：此病可以诊断为牙龈癌。治疗以外科手术为主。早期下牙龈癌仅波及牙槽突时，应将原发灶及下颌骨作方块切除，以保持颌骨的连续性及功能。有条件也可同期进行植骨修复。由于下颌牙龈癌淋巴结转移率较高，一般应同期进行选择性颈淋巴清扫术。上牙龈癌应作上颌骨次全切除。如已经波及上颌窦，则将上颌骨全切。上牙龈癌一般不同期进行选择性颈淋巴清扫术，应加强术后随访观察，待有临床指征时，再行颈淋巴清扫术。掌握“鳞状细胞癌概述及舌癌、牙龈癌”知识点。